发生右心衰时，引起组织水肿的主要原因
A. 毛细血管压力升高
B. 血浆胶体渗透压降低
C. 组织液静水压降低
D. 淋巴回流受阻
E. 毛细血管通透性增高

正确答案：A。毛细血管压力升高

解析：组织液的生成主要与有效滤过压有关，有效滤过压=（毛细血管血压+组织液胶体渗透压）-（组织液静水压+血浆胶体渗透压）。右心衰竭的病人体循环静脉压增高，静脉回流受阻，全身毛细血管后阻力增大，毛细血管血压增高（A对），有效滤过压增高，使组织液生成过多，所以下肢水肿。血浆胶体渗透压降低（B错）主要见于白蛋白降低，组织液生成增多。组织液静水压降低（C错）对组织液的生成影响较小。淋巴回流受阻（D错）主要见于丝虫病患者的淋巴管被堵塞，含蛋白质的淋巴液在组织间隙集聚，形成淋巴水肿。毛细血管通透性增高（E错）引起的水肿主要是由于炎症、过敏反应等。